我国居民碳水化合物的主要来源是
A. 葡萄糖
B. 蔗糖
C. 淀粉
D. 糖原
E. 纤维素

正确答案：C。淀粉